小儿化脓性脑膜炎合并脑积水原因是
A. 由于炎症累及下丘脑和垂体
B. 由于不规律用药
C. 由于血脑屏障功能差
D. 由于炎性渗出物阻碍脑脊液循环而致
E. 以上都不是

正确答案：D。由于炎性渗出物阻碍脑脊液循环而致

解析：小儿化脓性脑膜炎合并脑积水时主要是因为炎症渗出物粘连堵塞脑室内脑脊液流出通道（D对），如导水管、第四脑室侧孔或正中孔等狭窄处，引起非交通性脑积水。而当炎症累及下丘脑和垂体（A错）时，可出现抗利尿激素异常分泌综合征；不规律用药（B错）可引起化脓性脑膜炎病情加重，可也引起一系列并发症，如脑室管膜炎等；血脑屏障功能差（C错）时可引起致病菌通过血脑屏障，引起脑实质的损害等。